新生儿，诊断为右侧完全性唇、腭裂。最先实施的手术治疗是
A. 新生儿正畸
B. 牙槽突裂植骨术
C. 唇裂修复术
D. 腭裂修复术
E. 颌骨正畸术

正确答案：C。唇裂修复术

解析：本题考查唇腭裂的治疗。对于唇腭裂患儿，早期进行唇裂修复术（C对），可以尽早地恢复上唇的正常功能和外形，并可使瘢痕组织减少到最小程度，同时唇裂整复后，由于唇肌生理运动，可以产生压迫作用，促使牙槽突裂隙逐渐靠拢，为以后的腭裂创造条件，所以最先实施的手术治疗是唇裂修整术。刚出生的新生儿牙齿还未萌出，没有条件进行新生儿正畸（A错）治疗。牙槽突裂植骨术（B错）应推迟到混合牙列期，通常在尖牙萌出以前大约9-11岁时进行手术，过早实施手术会对上颌骨的生长发育产生不利影响。腭裂整复术较为复杂，所需治疗的周期也较唇裂更长，所以应放在唇裂整复术的后面。因此临床上通常在患儿两岁左右进行腭裂整复术（D错）。颌骨正畸术通常待患者成年后进行，此时上颌骨发育完全，既不影响上颌骨发育又能保证手术效果，新生儿颌骨此时未发育成型，不能进行颌骨正畸术（E错）。